评价职业性有害因素的最常用的方法是
A. 有害因素危险度评价
B. 生物监测
C. 健康监护
D. 职业流行病学调查
E. 环境监测

正确答案：E。环境监测